下列属于Ⅲ型超敏反应性疾病的是
A. 过敏性溶血性贫血
B. 类风湿关节炎
C. 枯草热
D. 结核
E. 青霉素引起的过敏性休克

正确答案：B。类风湿关节炎

解析：临床常见的Ⅲ型超敏反应性疾病：类风湿关节炎：病毒或支原体感染等因素可使体内IgG发生变性，变性的IgG可作为抗原刺激人体产生抗自身IgG的IgM、IgG或IgA抗体，这些抗体被称为类风湿因子（RF）。自身变性IgG与类风湿因子形成的免疫复合物可沉积于关节滑膜引起类风湿关节炎。掌握“概述及Ⅰ型超敏反应”知识点。